某社区研究某项措施预防冠心病的作用，实验组用该项措施，对照组用无任何作用的糖丸，这属于
A. 实验对照
B. 空白对照
C. 安慰剂对照
D. 标准对照
E. 历史对照

正确答案：C。安慰剂对照

解析：本题考查安慰剂对照的概念。安慰剂对照（C对ABDE错）是指在所研究的疾病尚无有效的治疗药物或使用安慰剂后对研究对象的病情无影响时才使用。题中对对照组提供无作用的糖丸属于安慰剂对照。